有机磷农药中毒所出现的症状分为
A. 毒蕈碱样症状
B. 烟碱样症状
C. 骨骼系统症状
D. 泌尿系统症状
E. 中枢神经系统症状

正确答案：A、B、E。毒蕈碱样症状；烟碱样症状；中枢神经系统症状

解析：本题考查有机磷农药中毒。有机磷中毒所出现的症状大致可分为毒蕈碱样症状（A对）、烟碱样症状（B对）及中枢神经系统症状（E对）三大症候群。（1）毒蕈碱样症状：由于副交感神经异常
激动，导致内脏平滑肌、腺体以及汗腺等兴奋，产生与毒蕈碱中毒类似的症状。表现为食欲减退、恶心、呕吐、腹痛、腹泻、瞳孔缩小、视物模糊、多汗、流涎、支气管痉挛、呼吸道分泌物增多、呼吸困难、发绀等。（2）烟碱样症状：由于交感神经与运动神经受到刺激，导致交感神经节及横纹肌兴奋性增加而引起的症状。主要表现为肌肉震颤、抽搐、肌无力、心率加快、血压升高等。（3）中枢神经系统症状：主要表现为眩晕、头痛、乏力、烦躁不安、发热、失眠、震颤、精神恍惚、言语不清、惊厥、昏迷等。